患妇，28岁。足月顺产后2周开始下床活动，觉左下肢痛，肿胀，左下肢皮肤略发绀，皮温高，表浅静脉曲张，沿左股静脉走行区有明显压痛，应考虑为
A. 血栓性股静脉炎
B. 血栓性大隐静脉炎
C. 局限性股深静脉血栓形成
D. 左髂股静脉血栓形成
E. 以上都不对

正确答案：D。左髂股静脉血栓形成

解析：青年女性患者，足月顺产（产后血液常处于高凝状态）后2周开始下床活动（长时间卧床可使下肢静脉血液缓慢），觉左下肢痛，肿胀（提示梗阻位置较高），左下肢皮肤略发绀，皮温高，表浅静脉曲张，沿左股静脉走行区有明显压痛（下肢深静脉血栓形成的典型表现）。综合该患者的病史及体查，诊断应考虑左髂-股静脉血栓形成（D对E错）。局限性股深静脉血栓形成（C错）主要表现为大腿肿痛，但下肢肿胀不明显，系因髂-股静脉通畅，深静脉血可循下肢深静脉→交通静脉→大隐静脉→股静脉→髂外静脉回流。血栓性股静脉炎（A错）与血栓性大隐静脉炎（B错）为静脉的急性非化脓性炎症，病变静脉区呈红肿条索状，疼痛及压痛明显，局部皮肤温度升高。